小儿实热证的脉象是
A. 沉而有力
B. 数而有力
C. 数而无力
D. 浮而无力
E. 迟而有力

正确答案：B。数而有力

解析：小儿脉象，主要分浮、沉、迟、数、有力、无力这六种，以辨别疾病的表里、寒热、虚实。脉搏频速，来去急促，一息六七次以上为脉数，多见于热证，数而有力为实热，数而无力为虚热，故小儿实热证的脉象是数而有力（B对）。沉而有力（A错）为里实证。数而无力（C错）为虚热证。浮而无力（D错）为表虚证。迟而有力（E错）为寒滞实证。